黏合力强，可用来增加片剂硬度，但吸湿性较强的辅料是
A. 羟丙基甲基纤维素
B. 硫酸钙
C. 微晶纤维素
D. 淀粉
E. 糖粉

正确答案：E。糖粉

解析：本题考查片剂的常用辅料。糖粉（E对）系指结晶性蔗糖经低温干燥粉碎后而成的白色粉末。本品黏合力强，可增强片剂硬度，但吸湿性较强，长期贮存会使片剂的硬度过大，延缓崩解或溶出。
羟丙基甲基纤维素（A错）是一种最为常用的胃溶型薄膜衣材料，因其溶于冷水成为黏性溶液，故亦常用其2%～5%的溶液作为黏合剂使用。无机钙盐类（如硫酸钙（B错）、磷酸氢钙及碳酸钙等）、微晶纤维素（C错）和淀粉（D错）常用作片剂的稀释剂。